下列毒物动力学参数中与分布有关的是
A. CL
B. Ke
C. t1/2
D. Vd
E. AUC

正确答案：D。Vd